邪气亢盛，正气不虚形成的病证是
A. 实证
B. 虚证
C. 虚实夹杂证
D. 真虚假实证
E. 真实假虚证

正确答案：A。实证

解析：实证是指邪气的致病力强盛，而正气的抗病能力未衰，能积极与邪抗争，故正邪斗争激烈，反应明显，临床上出现一系列病变反应变化比较剧烈的亢盛有余的证候（A对）。虚证是指正气不足，以正气虚损为矛盾主要方面的病机变化（B错）。虚实夹杂，指在疾病的过程中，邪盛和正虚同时存在的病机变化（C错）。真虚假实证是指病机的本质为“虚”，但表现出“实”的临床假象（D错）。真实假虚证是指病机的本质是“实”，但表现出“虚”的临床假象（E错）。